2015版《中国药典》一部规定检查千里光药材毒性成分限量的方法是
A. 高效液相-质谱法
B. 气-质联用法
C. 薄层色谱法
D. 高效液相色谱法
E. 气相色谱法

正确答案：A。高效液相-质谱法

解析：本题考查的是中药安全性检查的检查方法。2015版《中国药典》一部规定检查千里光药材毒性成分限量的方法是高效液相-质谱法（A对）。《中国药典》对毒性成分的测定多采用高效液相色谱法（D错），如制川乌、制草乌、附子中的双酯型生物碱（以含新乌头碱、次乌头碱、乌头碱的总量计），马钱子中的士的宁，斑蝥中的斑蝥素等。千里光中的阿多尼弗林碱、川楝子和苦楝皮中的川楝素等毒性成分测定采用高效液相色谱-串联质谱法，解决了常规高效液相色谱法灵敏度较低、分离不理想的问题。有毒中药药材加工成饮片后，毒性成分减少，如《中国药典》规定乌头碱、次乌头碱和新乌头碱的总量在川乌药材中应为0.050%～0.17%，在制川乌饮片中不得过0.040%；士的宁在马钱子药材中应为1.20%～2.20%，在马钱子粉中应为0.78%～0.82%。气-质联用法（B错）可用于莪术挥发油的分析测定。薄层色谱法（C错）可用于分离、定性及定量测定。气相色谱法（E错）（GC）的测定对象主要是易于挥发、热稳定性好的样品，如含挥发油或其他挥发性成分的中药。